龈缘炎的临床表现
A. 疼痛明显
B. 自发出血
C. 牙周袋形成
D. 牙排列拥挤
E. 牙颈部常有牙石、软垢沉积

正确答案：E。牙颈部常有牙石、软垢沉积

解析：本题考查龈缘炎的临床表现。龈缘炎牙颈部常有牙石、软垢沉积，含大量菌斑（E对）。龈缘炎又称慢性龈炎，疼痛不明显，有些患者可感到牙龈局部痒、胀、不适，有口臭等症状（A错）。无自发出血，常在刷牙或咬硬物时出血（B错）。无牙周袋形成（C错），若有牙周袋说明慢性龈炎已进展至牙周炎。牙排拥挤，牙齿不易清洁，易引起龈缘炎，所以牙排列拥挤是引起龈缘炎的一个病因（D错）。